心功能不全肺淤血时，在痰中出现的是
A. 白细胞
B. 夏科—雷登结晶体
C. 上皮细胞
D. 色素细胞
E. 枯什曼螺旋体

正确答案：D。色素细胞

解析：心功能不全肺瘀血时，在痰中出现的是色素细胞（D对），即含铁血黄素细胞。痰中出现白细胞（A错）见于各种呼吸道炎症。痰中出现夏科—雷登结晶体（B错）见于支气管哮喘及肺吸虫病患者。痰中出现上皮细胞（C错）见于呼吸道炎症，上呼吸道炎症多见口腔鳞状上皮细胞，下呼吸道炎症多见纤维柱状上皮细胞。杜什曼螺旋体（E错）见于支气管哮喘患者。